孕早期患下列何种疾病，应终止妊娠
A. 细菌性阴道炎
B. 巨细胞病毒感染
C. 沙眼衣原体感染
D. 外阴阴道念珠菌感染
E. 生殖道尖锐湿疣

正确答案：B。巨细胞病毒感染

解析：孕妇巨细胞病毒感染，约15%的胎儿会出现胎儿生长受限、小头畸形、溶血性贫血等，85%出生时无症状，但其中5%～15%远期出现感觉神经性耳聋、精神运动发育迟缓、视力障碍等后遗症，且目前对CMV感染无特效的治疗方法。故孕早期确诊原发性或发现宫内CMV感染时，应向孕妇及家属交待可能后果以决定胎儿取舍（B对）。细菌性阴道炎（P251）（A错）、沙眼衣原体感染（P106）（C错）、外阴阴道念球菌感染（P248）（D错）及生殖道尖锐湿疣（P104）（E错）对胎儿多无影响且有有效治疗方法。